面部的发育来自
A. 上颌突和球状突
B. 侧腭突和球状突
C. 侧腭突和侧鼻突
D. 额鼻突和下颌突
E. 侧腭突和上颌突

正确答案：D。额鼻突和下颌突

解析：本题考查面部的发育。面部的发育来自额鼻突和下颌突（D对）。1.面部的发育来自于第一鳃弓和额鼻突衍化出的面突，它们是额鼻突衍化出的一个中鼻突（包括球状突）和两个侧鼻突；第一鳃弓即两个下颌突及其衍化出来的两个上颌突。2.腭的发育来自于原发腭（前腭突）和继发腭（侧腭突），其中前腭突的发生早于侧腭突。